复面洞做成阶梯的作用不包括
A. 分散（牙合）力
B. 少切割牙体组织
C. 利于充填
D. 保护牙髓
E. 抗力形

正确答案：C。利于充填

解析：本题考查窝洞的结构-抗力形。复面洞做成阶梯的作用不包括利于充填（C错，为本题的正确答案）。复面洞充填时邻面需恢复邻接关系，且邻面易形成悬突，不利于充填操作。阶梯可以分散（牙合）力（A对），使（牙合）力由（牙合）面髓壁和邻面龈壁分担，减少直接作用于牙髓的力，从而保护牙髓（D对）。复面洞的洞底形成梯阶，在预备窝洞时，可以使其深度相比于单面洞减小，从而在一定程度上减少对牙体组织的切割（B对）。复面洞做成阶梯结构，属于抗力形的一种，可以使充填体和余留牙体组织获得足够抗力，在承受咬合力时不折裂（E对）。